丙咪嗪的药理作用是
A. 抗精神病
B. 抗抑郁作用
C. 镇吐作用
D. 收缩外周血管作用
E. 抗癫痫作用

正确答案：B。抗抑郁作用

解析：本题考查丙咪嗪。丙咪嗪的药理作用是抗抑郁作用（B对）。丙咪嗪为三环类抗抑郁药，主要通过抑制突触前膜对5-HT及去甲肾上腺素的再摄取，使突触间隙的去甲肾上腺素和5-HT浓度升高，促进突触传递功能而发挥抗抑郁作用。此类药物还有阿米替林、氯米帕明、多塞平等。